Glickman的Ⅱ度根分叉病变是指
A. 牙周探诊触及根分叉
B. 牙周探诊可探入根分叉中，但未能贯通
C. 牙周探诊可贯通颊舌根分叉，牙龈覆盖根分叉区
D. 牙龈覆盖根分叉，X-ray示根分叉完全透影区
E. 根分叉颊舌侧贯通暴露在口腔中

正确答案：B。牙周探诊可探入根分叉中，但未能贯通

解析：本题考查Glickman的Ⅱ度根分叉病变。Glickman将根分叉病变分为四度，牙周探诊可探入根分叉中，但未能贯通（B对）为Ⅱ度根分叉病变。牙周探诊触及根分叉（A错）为Ⅰ度根分叉病变。牙周探诊可贯通颊舌根分叉，牙龈覆盖根分叉区（C错）、X-ray示根分叉完全透影区（D错）为Ⅲ度根分叉病变。根分叉颊舌侧贯通暴露在口腔中（E错）为Ⅳ度根分叉病变。